关于类天疱疮的治疗，下列哪项说法是错误的
A. 可用泼尼松口服
B. 局部抗炎、止痛
C. 避免日光照射
D. 中医中药治疗
E. 防止眼结膜纤维性粘连

正确答案：C。避免日光照射

解析：本题考查类天疱疮的治疗。避免日光照射（C错，为本题正确答案）不属于类天疱疮的治疗方法。类天疱疮的治疗需消除口腔局部刺激因素，口腔用药基本同天疱疮的局部治疗，进行局部抗炎、止痛（B对）。糜烂较局限者可用糖皮质激素制剂如曲安奈德混悬液行口腔黏膜损害下浸润注射治疗，但应控制好注射频率及剂量，以免引起组织萎缩、硬化等不良反应。有眼部损害者，需用糖皮质激素制剂的溶液滴眼防止眼结膜纤维性粘连（E对）。全身治疗，对于低危险型黏膜类天疱疮，在局部应用糖皮质激素制剂的同时，可使用氨苯砜，氨苯砜的起始剂量为50～200mg/d ，通常疗程12周，有效剂量为100～200mg/d。常见不良反应包括溶血性贫血及高铁血红蛋白血症、骨髓抑制和肝中毒等，为预防溶血性贫血和高铁血红蛋白血症，可服用维生素或西咪替丁。若口腔黏膜损害广泛而病情严重，可用泼尼松口服（A对），对于多数局限于口腔的黏膜类天疱疮来说，较低起始剂量的泼尼松即可控制病情，病情控制后逐渐减量，同时可配合中医中药治疗（D对）减少糖皮质激素的副作用。